若将釉质钙化不全的牙齿进行X线检查，则会发现其硬度与以下哪种组织相似
A. 牙骨质
B. 牙本质
C. 牙髓
D. 牙槽骨
E. 牙周膜

正确答案：B。牙本质

解析：釉质钙化不全的牙齿其釉基质形成正常但无明显的矿化，X线检查示釉质硬度与牙本质相似。掌握“釉质形成缺陷（釉质发育不全）”知识点。